作为第二信使的离子是哪个
A. 钠离子
B. 钾离子
C. 氯离子
D. 钙离子
E. 镁离子

正确答案：D。钙离子

解析：本题考查受体作用的信号转导。第二信使为第一信使作用于靶细胞后在胞质内产生的信息分子。第二信使包括环磷腺苷（cAMP）、环磷酸鸟苷（cGMP）、IP₃、DAG、PGs、Ca²⁺（D对）、廿碳烯酸类、一氧化氮（NO）等。